男，35岁。发热、咳黄痰10天，水肿伴恶心、呕吐、呼吸困难1周，1天前突发抽搐昏迷。既往IgA肾病5年。查体：BP180/110mmHg，贫血貌，深大呼吸，双中下肺野闻及湿啰音，心率120次/分。双下肢水肿。Hb68g/L，Scr1325umol/L。当前最有效的治疗措施是
A. 血液透析
B. 大剂量利尿剂
C. 输血
D. 降压
E. 抗感染

正确答案：A。血液透析

解析：青年男性患者，既往IgA肾病5年。发热、咳黄痰10天（提示合并肺部感染，感染为慢性肾衰竭急性加重的常见诱因）。水肿（水、钠潴留引起）伴恶心、呕吐（伴发消化道症状，是慢性肾衰最早最突出的症状）、呼吸困难1周（考虑由肺部感染引起）。查体：BP180/110mmHg（正常为90～130/60～90mmHg，提示有高血压），贫血貌、Hb68g/L（正常为120～160g/L，提示有贫血），心率120次/分（正常为60～100次/分，提示心率增快）、深大呼吸、双中下肺野闻及湿罗音（肺部感染的表现）。Scrl325μmol/L（血肌酐正常为88.4～176.8μmol/L，提示血肌酐升高）。综合患者的病史、临床表现、实验室检查，考虑诊断为慢性肾衰竭。根据我国慢性肾衰竭的分期方法判断（Scr≥707μmol/L为尿毒症阶段），该患者已处于尿毒症阶段。患者突发抽搐、昏迷，提示已合并有尿毒症脑病，应当紧急治疗，当前最有效的治疗措施是血液透析（A对）。血液透析可以迅速清除体内的代谢废物、缓解症状，延缓病情进展。适量的利尿剂治疗有助于缓解患者的高血压、水肿等症状，但大剂量利尿剂（B错）可导致电解质紊乱，应慎用。输血（C错）可加重氮质血症，不宜用于尿毒症的患者。降压（D错）、抗感染（E错）均为对症治疗，只能缓解症状。